石棉肺最主要的症状是
A. 胸痛和咳嗽
B. 咳嗽和呼吸困难
C. 呼吸困难和胸痛
D. 咳痰和呼吸困难

正确答案：B。咳嗽和呼吸困难

解析：本题考查石棉肺的症状。患有石棉肺的病人自觉症状出现比矽肺早，主要是咳嗽和呼吸困难（B对ACD错）。咳嗽一般为干咳或少许黏液性痰，难咳出。呼吸困难早期出现于体力活动时，晚期病人在静息时也发生气急的症状。